患者，男性，70岁，高热，畏寒，剧烈头痛入院，用青霉素无效，发病第5天，除面部外于胸肩等处出现鲜红色斑丘疹，于内衣见有虱虮，发病10天，外斐试验效价：1∶400，诊断为斑疹伤寒宜选用
A. 庆大霉素
B. 磺胺嘧啶
C. 头孢他啶
D. 链霉素
E. 多西环素

正确答案：E。多西环素